引起低磷血症的原因是
A. 长期使用利尿剂
B. VitD缺乏
C. 呼吸性碱中毒
D. 甲状旁腺功能亢进
E. 以上都是

正确答案：E。以上都是

解析：长期使用利尿剂（A对）使尿磷排泄增加，VitD缺乏（B对）影响磷的吸收，呼吸性碱中毒（C对）时细胞内氢离子相对较高，磷向细胞内转移，甲状旁腺功能亢进（D对，故E为本题正确答案）PTH分泌增多，抑制近曲小管及远曲小管对磷的重吸收，尿磷排泄增加，这些都会导致低磷血症。